患者怀孕3次，均有自然流产，平素头晕目眩，神疲乏力，心悸气短，舌质淡，苔薄白，脉细弱，治疗首选的方剂是
A. 泰山磐石散
B. 寿胎丸
C. 肾气丸
D. 安奠二天汤
E. 补肾固冲丸

正确答案：A。泰山磐石散

解析：患者怀孕3次，均有自然流产，为滑胎；平素头晕目眩，神疲乏力，心悸气短，舌质淡，苔薄白，脉细弱为气血虚弱的表现，治法益气养血，固冲安胎，用泰山磐石散（A对）。滑胎血瘀证用桂枝茯苓丸合寿胎丸（B错）。滑胎肾阳亏虚用肾气丸（C错）。滑胎脾肾虚弱用安奠二天汤（D错）。滑胎肾气不足用补肾固冲丸（E错）。